颊红，烦躁，四肢厥逆，下利清谷，脉微欲绝，属于
A. 阳盛格阴
B. 阴盛格阳
C. 阴阳偏盛
D. 阴阳偏衰
E. 阴阳消长

正确答案：B。阴盛格阳

解析：本题考查的是阴阳失调病机的内容。颊红，烦躁，四肢厥逆，下利清谷，脉微欲绝，属于阴盛格阳（B对）。阴阳失调，即是阴阳消长（E错）失去平衡协调的简称。是指机体在疾病的发生发展过程中，由于各种致病因素的影响，导致机体阴阳消长失去相对的平衡，从而形成阴阳偏盛、偏衰，或阴不制阳、阳不制阴的病变状态。1.阴阳偏盛（C错）：又称“阴阳偏胜”，阴或阳的偏盛，主要是指“邪气盛则实”的实证。病邪侵入人体，必从其类。阳邪侵入人体，可形成阳偏盛，阴邪侵入人体，可形成阴偏盛。阳盛则热，阴盛则寒，明确地指出了阳偏盛和阴偏盛病机的临床表现特点。2.阴阳偏衰（D错）：阴或阳的偏衰，是指“精气夺则虚”的虚证。“精气夺”，实质上是包括了机体的精、气、血、津液等基本物质的不足及其生理功能的减退，同时也包括了脏腑、经络等生理功能的减退和失调。3.阴阳互损：阴阳互损，是指阴或阳任何一方虚损到相当程度，病变发展影响及相对的一方，形成阴阳两虚的病变机制。（1）阴损及阳：阴损及阳，是指由于阴气亏损，累及阳气生化不足，或阳气无所依附而耗散，从而在阴虚的基础上又出现了阳虚，形成以阴虚为主的阴阳两虚的病机变化。（2）阳损及阴：阳损及阴，是指由于阳气虚损，无阳则阴无以生，从而在阳虚的基础上又导致了阴虚，形成以阳虚为主的阴阳两虚的病机变化。4.阴阳格拒：阴阳格拒，是阴阳失调病机中比较特殊的一类病机。（1）阴盛格阳：阴盛格阳，是指阴寒之邪壅盛于内，逼迫阳气浮越于外，使阴阳之气不相顺接、相互格拒，表现为真寒假热的病机变化。病变本质是阴寒内盛，临床可见四肢厥逆、下利清谷、脉微欲绝等症状；又可见阳浮于外，症见身热反不恶寒（但欲盖衣被）、面颊泛红等假热之象。（2）阳盛格阴（A错）：阳盛格阴，是指邪热过盛，深伏于里，阳气被遏，郁闭于内，不能外透布达于肢体，从而形成阴阳排斥，而格阴于外，表现为真热假寒的病机变化。病变本质是阳热内盛，临床可见身热、面红、气粗、烦躁等症状外；又突然出现四肢厥冷（但身热不恶寒）、脉象沉伏（但沉数有力）等假寒之象。5.阴阳亡失：阴阳亡失是机体的阴液或阳气突然大量地亡失，导致生命垂危的一种病变状态。